某女性患者，45岁，体检结果显示：血压180/100mmHg，体重68Kg，身高160cm（BMI=26.6），甘油三酯4.5mmol/L，胆固醇5.1mmol/L。该患者营养状况判断为
A. 肥胖
B. 严重肥胖
C. 消瘦
D. 超重
E. 正常

正确答案：D。超重

解析：人体测量是评价营养状况的综合观察指标，常用的指标有体重、身高、皮褶厚度及上臀围等，其中以体重，身高最为重要，BMI=体重（kg）/[身高（m）]2。本题中BMI=26.6在24.0～27.9范围内，故属于超重（D对）。肥胖（AB错）是BMI≥28。消瘦是（C错）BMI＜18.5。正常（E错）是BMI为18.5～23.9。